具有强大的抗凝血因子Xa功能及微弱的抗凝血酶作用，可用于预防深静脉血栓形成的药物是
A. 尿激酶
B. 那屈肝素钙
C. 华法林
D. 阿加曲班
E. 双嘧达莫

正确答案：B。那屈肝素钙

解析：本题考查药物的作用。那屈肝素钙（B对）为低分子肝素，在体外具有明显的抗凝血因子Xa活性和较低的抗凝血因子Ⅱa或凝血酶的活性，具有快速、持续的抗血栓作用。尿激酶（A错）为溶栓药，临床用于血栓栓塞性疾病的溶栓治疗。华法林（C错）为维生素K拮抗剂类抗凝血药，临床用于预防和治疗深静脉血栓。阿加曲班（D错）是新型凝血酶抑制剂，可用于缺血性脑梗死急性期病人的抗凝治疗。双嘧达莫（E错）属于磷酸二脂酶抑制剂，临床用于缺血性心脏病、血栓栓塞性疾病，心肌缺血的诊断试验。